以下哪项疾病，血沉不增快
A. 多发性骨髓瘤
B. 胃癌
C. 活动性肺结核
D. 风湿热
E. 真性红细胞增多症

正确答案：E。真性红细胞增多症